关于视神经盘的描述，哪项是正确的？
A. 为感光最敏锐部
B. 为生理性盲点
C. 位于眼球后极的颞侧
D. 位于黄斑外侧
E. 无视神经出入

正确答案：B。为生理性盲点

解析：视神经盘位于眼球后极的鼻侧，而非颞侧（C错），位于黄斑鼻侧，即黄斑内侧，而非外侧（D错），有节细胞的轴突构成的视神经出入（E错），且无感光细胞分布，故为生理性盲点（B对）。感光最敏锐部（A错）是黄斑，而非视神经盘。